男，45岁。发热、咳脓痰1周。胸部X线片示右下叶背段浸润阴影。用头孢呋辛治疗体温稍下降，但痰量增多，为脓血痰，有臭味。1周后复查胸部X线片示大片浸润阴影中出现空洞。治疗2周后，患者临床症状明显改善，胸部X线片示空洞缩小。抗感染的总疗程应为
A. 8～12周
B. 6～8周
C. 3～6周
D. 2～4周
E. 7～10周

正确答案：B。6～8周

解析：患者发热、咳脓臭痰（为肺脓肿的典型临床表现），胸部X线片示右下叶背段浸润阴影，且出现空洞（为肺脓肿的典型胸片改变），可初步诊断为肺脓肿。该患者用头孢呋辛（为二代头孢类抗生素，对革兰阳性菌和革兰阴性杆菌有效，对厌氧菌无效）治疗体温稍下降，但痰量增多，为脓血痰，有臭味，说明肺脓肿感染的细菌为厌氧菌。肺脓肿抗生素疗程6～8周（B对），如果疗程过后仍不好转，则更换治疗方案。需注意的是，对于肺脓肿抗生素疗程的数据，七九版内科学数据有差异，第七版的数据为8～12周（P38），答题的时候以最新的九版内科学为准。